水体的自净是指
A. 水体污染物的总量逐渐减少
B. 水体污染物的浓度逐渐降低，水质好于污染前的水平
C. 水体污染物的浓度降低，水质逐渐恢复到污染前的水平
D. 水体中的污染物浓度无明显改变，但水体可以使用
E. 水体中的污染物总量没改变，浓度也没增加

正确答案：C。水体污染物的浓度降低，水质逐渐恢复到污染前的水平

解析：本题考查水体的自净。水体的自净是指水体受污染后，污染物在水体的物理、化学和生物学作用下，使污染成分不断稀释、扩散、分解破坏或沉入水底，水中污染物浓度逐渐降低，水质最终又恢复到污染前的状况（C对ABDE错）。